脊髓丘脑束的细胞体在
A. 同侧脊神经节内
B. 对侧脊神经节内
C. 同侧脊髓后角内
D. 对侧脊髓后角内
E. 对侧脊髓前角内

正确答案：D。对侧脊髓后角内

解析：脊髓丘脑束是传导躯干和四肢浅感觉的纤维束之一。躯干和四肢痛温觉、粗略触觉和压觉传导通路中，传导痛温觉的纤维（细纤维）在后根的外侧部入脊髓后角内，再终止于第2级神经元；传导粗略触觉和压觉的纤维（粗纤维）经后根内侧部进入脊髓后角内，再终止于第2级神经元。第二级神经元发出纤维上升 1-2 个节段经白质前连合交叉到对侧的外侧索和前索内上行，组成脊髓丘脑侧束和脊髓丘脑前束（侧束传导痛温觉，前束传导粗略触觉和压觉）。由于经过白质前连合，交叉到对侧，所以脊髓丘脑束的细胞体在对侧脊髓后角内（D对）。